男性，33岁。咳嗽、发热1周，体温38.5℃，皮肤有大块瘀斑，血红蛋白85g/L，白细胞总数3✕10⁹/L，中性粒细胞0.32，淋巴细胞0.64，未见幼稚细胞，血小板3.2✕10⁹/L，凝血酶原时间15秒（对照12秒），3P试验弱阳性。最可能诊断是
A. 再生障碍性贫血
B. 急性白血病
C. 肺炎并发DIC
D. 原发性血小板减少性紫癜
E. 维生素K缺乏

正确答案：B。急性白血病